下列何结构位于口咽部
A. 咽鼓管圆枕
B. 咽扁桃体
C. 咽隐窝
D. 腭扁桃体
E. 无

正确答案：D。腭扁桃体

解析：咽鼓管圆枕(A错)、咽扁桃体(B错)和咽隐窝(C错)都位于鼻咽部，腭扁桃体(D对)位于口咽部。